未取得批准文号生产的药品为
A. 保健品
B. 特殊管理的药品及外用药
C. 假药
D. 劣药
E. 新药

正确答案：C。假药

解析：本题考查假药。未取得批准文号生产的药品为假药（C对）。《药品管理法》第九十八条第一款、第二款规定，禁止生产（包括配制，下同）、销售、使用假药。有下列情形之一的，为假药：①药品所含成分与国家药品标准规定的成分不符的；②以非药品冒充药品或者以他种药品冒充此种药品的。有下列情形之一的药品，按假药论处：①国务院药品监督管理部门规定禁止使用的；②依照本法必须批准而未经批准生产、进口，或者依照本法必须检验而未检验即销售的；③变质的；④被污染的；⑤使用依照本法必须取得批准文号而未取得批准文号的原料药生产的；⑥所表明的适应症或者功能主治超出规定范围的。特殊管理药品（B错）是指《药品管理法》第35条规定的药品，即国家对麻醉药品、精神药品、医疗用毒性药品、放射性药品实行特殊管理。根据《药品管理法》第九十八条第三款规定，有下列情形之一的，为劣药（D错）：①药品成分的含量不符合国家药品标准；②被污染的药品；③未标明或者更改有效期的药品；④未注明或者更改产品批号的药品；⑤超过有效期的药品；⑥擅自添加防腐剂、辅料的药品；⑦其他不符合药品标准的药品。新药（E错）系指未曾在中国境内上市销售的药品。